治疗心绞痛心肾阳虚证，应首选
A. 济生肾气丸
B. 半夏白术天麻汤
C. 六味地黄丸
D. 当归参附汤合右归丸
E. 当归四逆汤合苏合香丸

正确答案：D。当归参附汤合右归丸

解析：心绞痛心肾阳虚证，治宜益气壮阳，温经止痛，首选益气补血，回阳固脱的当归参附汤合温补肾阳，填精益髓的右归丸（D对）。济生肾气丸温补肾阳，化生肾气，主治肾阳气不足证（A错）。半夏白术天麻汤化痰息风，健脾祛湿，主治风痰上扰证，为高血压痰湿内阻证的代表方（B错）。六味地黄丸填精滋阴补肾，主治肾阴精不足证（C错）。当归四逆汤温经散寒，养血通脉，主治血虚寒厥证；苏合香丸温通开窍，行气止痛，主治寒闭证（E错）。